男，56岁。间断咳嗽、咳痰3年余。偶有痰中带血，经反复抗感染治疗效果欠佳，下肺纹理呈垂柳样改变。该患者最可能的诊断是
A. 克雷伯杆菌肺炎
B. 支气管扩张
C. 支气管炎
D. 干酪性肺炎
E. 肺结核

正确答案：E。肺结核

解析：患者咳嗽、咳痰，偶有痰中带血，经抗感染治疗效果不佳（肺结核抗感染治疗无效），考虑可能为肺结核，X线片示下肺纹理呈垂柳样改变（是纤维空洞性肺结核的典型表现），根据其临床表现和辅助检查，故该患者最可能的诊断为肺结核（E对）。克雷伯杆菌肺炎（A错）的患者多起病急，寒战高热，常伴全身衰竭，咳砖红色胶冻状痰，X线表现为肺叶或肺段实变，蜂窝状脓肿，可见液气囊腔，抗生素治疗有效。支气管扩张（P37）（B错）多好发于儿童和青年，临床表现主要为慢性咳嗽、咳大量浓痰和（或）反复咳血，典型X线表现为“双轨征”。支气管炎（C错）主要症状为咳嗽咳痰，早期X线无改变，反复发作者表现为纹理增粗紊乱，呈网状或条索状斑点状阴影。干酪性肺炎（D错）多发生于机体免疫力和体质衰弱，又受到大量结核分枝杆菌感染的患者，大叶性干酪性肺炎X线影像呈大叶性密度均匀的磨玻璃样阴影，有虫蚀样空洞；小叶性干酪性肺炎X线影像呈小叶斑片播散病灶。